Ⅰ型强心苷是
A. 苷元-（D-葡萄糖）y
B. 苷元-（6-去氧糖甲醚）x-（D-葡萄糖）
C. 苷元-（2，6-二去氧糖）x-（D-葡萄糖）
D. 苷元-（6-去氧糖）x-（D-葡萄糖）
E. 苷元-（D-葡萄糖）y-（2，6-二去氧糖）

正确答案：C。苷元-（2，6-二去氧糖）x-（D-葡萄糖）